以下关于口外型舌下腺囊肿的叙述中，正确的是
A. 常见于老年人
B. 囊肿呈浅紫蓝色
C. 触诊与皮肤粘连
D. 状似“重舌”
E. 穿刺可抽出蛋清样黏稠液体

正确答案：E。穿刺可抽出蛋清样黏稠液体

解析：舌下腺囊肿口外型又称潜突型。囊肿主要表现为下颌下区肿物，而口底囊肿表现不明显。触诊柔软，与皮肤无粘连，不可压缩，低头时因重力关系，肿物稍有增大。穿刺可抽出蛋清样黏稠液体。掌握“舌下腺及唾液腺黏液囊肿”知识点。